由美国医院药师协会编辑出版的二级文献是
A. 化学文摘
B. 生物学文摘
C. 医学文摘
D. 国际药学文摘
E. 医学索引

正确答案：D。国际药学文摘